男，30岁，餐后突发右上腹及剑突下痛，放射到右肩及后背部，二小时后疼痛剧烈，伴恶心，并吐出所进食物，仍不缓解，急诊就医。数年“胃病”史及胆石症历史，间有胆绞痛发作，查体：痛苦病容，体温37.2℃，呼吸28次/分，浅快，律齐。全腹胀，上腹肌紧张，压痛反跳痛（+）。移动性浊音（±），白细胞12×10⁹/L，血红蛋白125g/L，尿淀粉酶400U（温氏法正常值32μ）。下列初步诊断中，不可能的是
A. 胃十二指肠溃疡穿孔
B. 急性胆囊炎
C. 急性肠梗阻
D. 急性胰腺炎
E. 急性胃肠炎

正确答案：E。急性胃肠炎

解析：急性胃肠炎（E错，为本题正确答案）以腹痛、腹泻、发热为主要表现，无放射性疼痛，不会出现腹膜刺激症状和尿淀粉酶升高。胃十二指肠溃疡穿孔（A对）常见于有胃病病史的患者，多表现为突发的腹部剧烈疼痛和明显的腹膜刺激征，常伴呼吸浅快，可有尿淀粉酶升高。急性胆囊炎（B对）多见于胆囊结石的病人，饱食、进食油腻食物为其常见诱因，腹痛可放射至右肩、后背部，炎症累及壁腹膜时可有反跳痛和腹肌紧张。急性肠梗阻（C对）主要表现为腹痛、腹胀、呕吐及停止自肛门排便排气，发生绞窄后，肠管的炎性渗出累及腹膜时，可有压痛和腹膜刺激征；渗液较多时，可有移动性浊音阳性。急性胰腺炎（D对）常表现为饱餐和饮酒后突然发作的腹痛、腹胀、恶心、呕吐，呕吐后腹痛不缓解，严重者可有腹膜刺激征，移动性浊音阳性。